伯道疏螺旋体主要引起哪种疾病
A. 回归热
B. 狂犬病
C. 莱姆病
D. 波浪热
E. 钩体病

正确答案：C。莱姆病

解析：伯道疏螺旋体是莱姆病的主要病原体。掌握“概述及梅毒螺旋体”知识点。